下列不属于医学伦理指导原则的是
A. 防病治病，救死扶伤
B. 实行社会主义人道主义
C. 全心全意为人民身心健康服务
D. 以人为本
E. 不伤害

正确答案：E。不伤害

解析：医学伦理指导原则是防病治病，救死扶伤，实行社会主义人道主义，全心全意为人民身心健康服务。E为医学伦理基本原则不是指导原则。掌握“医学伦理的指导原则”知识点。